流行性出血热患者，出现酒醉面容是哪期
A. 发热期
B. 低血压期
C. 少尿期
D. 多尿期
E. 恢复期

正确答案：A。发热期

解析：流行性出血热发热期（A对）患者主要表现为发热、中毒症状、全身毛细血管损伤和肾脏损害。其毛细血管损伤征表现为颜面、颈部及上胸部呈弥漫性潮红，即“三红”征，似酒醉貌。低血压休克期（B错）主要为低血容量休克的表现：心率加快，脉细弱，四肢厥冷，烦躁不安，意识模糊，口唇及四肢末端发绀，呼吸短促，尿少等；长期组织灌注不良可见出血加重、合并MC、心力衰竭、水及电解质平衡失调等。少尿期（C错）表现为厌食、恶心、呕吐、腹胀和腹泻等，可有头晕、头痛、烦躁不安、嗜睡、抽搐、昏迷等，为尿素氮和氨类刺激作用所致；严重者可出现高血容量综合征和肺水肿。多尿期（D错）由于高渗性利尿，使尿量逐渐增多。恢复期（E错）随着尿液稀释与浓缩功能逐渐恢复正常，尿量恢复至每日2000mL以下，患者精神及食欲逐渐好转，但体力恢复较慢，需经1～3个月完全恢复正常。少数患者可遗留高血压、肾功能障碍、心肌劳损和垂体功能减退等症状。